患者，男，50岁。右额面部束带状刺痛5天，局部皮肤潮红。皮疹呈簇状水疱，排列如带状，小便黄，大便干，舌红苔薄黄，脉弦。治疗除取血海、三阴交、太冲，，还应加
A. 曲池、合谷、大椎
B. 外关、合谷、侠溪
C. 尺泽、合谷、大椎
D. 风池、合谷、膈俞
E. 曲池、合谷、支沟

正确答案：E。曲池、合谷、支沟

解析：该患者面部皮疹呈带状簇状水疱，且仅分布在右额部，有刺痛，可诊断为蛇串疮，带状疱疹循行与手少阳三焦经，为三焦火毒。大椎常作为急性热病的选穴，无治疗头面疼痛的功效（A错）。外关主治目赤肿痛、热病，侠溪用于蛇串疮肝经火毒证，而非三焦经（B错）。尺泽主治肺结核、咯血、肺炎等病症（C错）。风池、合谷、膈俞可用于治疗颈项强痛，癫痫等病证（D错）。曲池泄热，治疗五官热性病证；支沟主治便秘、热病，并且为疾病所在经脉，为本经取穴，面口合谷收，合谷为头面部病证的有效穴位（E对）。